孕妇感染风疹后引起胎儿畸形，这种传播病原体的方式被称为
A. 水平传播
B. 家庭传播
C. 血源性传播
D. 垂直传播
E. 间接传播

正确答案：D。垂直传播